治疗鹅口疮虚火上炎证，应首选
A. 清热泻脾散
B. 参苓白术散
C. 泻心导赤散
D. 黄连解毒汤
E. 六味地黄丸

正确答案：E。六味地黄丸

解析：鹅口疮虚火上炎证是由于阴虚水不制火，虚火循经上炎所致，治疗时应滋阴降火，首选知柏地黄丸（旧教材为"六味地黄丸加肉桂"）（E对）。清热泻脾散（A错）其功用为清脾泄热，使用于心脾蕴热之鹅口疮。参苓白术散（B错）其功用益气健脾，渗湿止泻，适应于脾虚泻。泻心导赤散（C错）其功用为清心泻火，适用于疱疹性口炎之心火上炎证。黄连解毒汤（D错）其功用为泻火解毒，适用于三焦火毒证。